能够舒张肾血管，增加肾血流量，可治疗急性肾功能衰竭的药物是
A. 肾上腺素
B. 去甲肾上腺素
C. 异丙肾上腺素
D. 多巴胺
E. 间羟胺

正确答案：D。多巴胺

解析：多巴胺（D对）主要激动α、β受体以及外周多巴胺受体，激动D1受体，过账肾血管，肾血流量和肾小球滤过率增加，尚有排钠利尿的作用，临床可与一些利尿药等合用于治疗急性肾功能衰竭。肾上腺素（A错）属于α、β受体激动剂，主要影响小动脉及毛细血管前括约肌同时激动血管上的α和β₂受体，分别产生缩血管和扩血管作用，肾脏血管平滑肌α受体占优势，故肾血管显著收缩。去甲肾上腺素（B错）对α受体有强大的激动作用，对β受体作用较弱，能够激动血管的α₁受体，收缩血管，其中皮肤、黏膜血管收缩最为明显，其次是肾脏血管。异丙肾上腺素（C错）属于经典的β₁、β₂受体激动剂，对α受体几乎无作用，激动血管平滑肌β₂受体，骨骼肌血管明显扩张，肾和肠系膜血管以及冠状血管有不同程度扩张，临床常用于支气管哮喘、房室传导阻滞自己心脏骤停。间羟胺（E错）直接兴奋α受体，对肾血管收缩作用较NA弱，临床可替代NA用于各种休克早期及手术或脊椎麻醉后的休克。